经白质前连合进行左右交叉的传导束是
A. 薄束和楔束
B. 皮质脊髓侧束
C. 皮质脊髓前束
D. 皮质脊髓前束和脊髓丘脑束
E. 无

正确答案：D。皮质脊髓前束和脊髓丘脑束

解析：薄束和楔束（A错）是脊神经后根内侧部的粗纤维在同侧脊髓后索的直接延续；皮质脊髓侧束（B错）在脊髓外侧索后部下行，直至骶髓纤维依次经各节段灰质中继后或直接终于同侧前角运动神经元；皮质脊髓前束和脊髓丘脑束（D对C错）均经白质前连合进行左右交叉。